属于脑干网状结构的神经核
A. 楔束核
B. 薄束核
C. 上丘灰质
D. 下丘核
E. 中缝核

正确答案：E。中缝核

解析：属于脑干网状结构的神经核的为中缝核（E对）。薄束核（B错）和楔束核（A错）为躯干四肢意识性本体感觉、精细触觉传导通路中的中继核团。上丘灰质（C错）为视觉反射中枢所在位置。下丘核（D错）是听觉传导通路中的中继核团，也是听觉反射中枢所在位置。